男性，25岁。主诉心前区疼痛2小时，向左肩放射，吸气时疼痛加重，坐位时减轻，伴有畏寒、发热就诊，体检：血压105/75mmHg，体温38度，心率110次/分，规则，心脏无杂音，两肺未见异常，有血吸虫病史。心电图示除aVR与V₁外各导联ST段抬高。入院第3天，血压90/75mmHg，颈静脉怒张，气息不能平卧，病情变化应考虑为
A. 再次肺梗塞
B. 心肌梗死扩大范围
C. 心脏压塞
D. 败血症
E. 心脏腱索断裂

正确答案：C。心脏压塞

解析：患者青年男性，心前区疼痛2小时，向左肩放射，吸气时疼痛加重，坐位时减轻（急性心包炎的典型胸痛特点），伴有畏寒发热（提示可能有病毒感染）；心电图示除aVR与V₁外各导联ST段抬高（急性心包炎常见的心电图表现），根据患者急性起病、典型胸痛和心电图表现，其最可能的诊断是急性心包炎。入院第3天，血压稍偏低，脉压（收缩压与舒张压之差，正常值30～40mmHg）变小，颈静脉怒张（体循环淤血表现），气息不能平卧，此时病情变化应考虑为急性心包炎造成大量心包积液而出现心脏压塞（C对）。病人并无肺梗塞和心肌梗死病史，故不会出现再次肺梗塞（A错）、心肌梗死扩大范围（B错）和心脏腱索断裂（心肌梗死常见的并发症）（E错）。败血症（D错）是指致病菌或条件致病菌侵入血循环，并在血中生长繁殖，产生毒素而发生的急性全身性感染。多伴有寒战高热，重者可有神智改变，感染性休克等表现，与本例不符，故排除。